下列乳腺癌病理类型中，预后最差的是
A. 浸润性小叶癌
B. 黏液癌
C. 小管癌
D. 乳头湿疹样癌
E. 导管内癌

正确答案：A。浸润性小叶癌

解析：乳腺癌分为：非浸润性癌、浸润性特殊癌、浸润性非特殊癌。非浸润性癌中的导管内癌（E错）、乳头湿疹样癌（D错）预后较好。浸润性特殊癌中的小管癌（C错）、黏液癌（B错）预后较好。浸润性非特殊癌中的浸润性小叶癌（A对）预后最差（九版病理学P296-P297）。